复合树脂充填时首选基底料
A. 氧化锌丁香油水门汀
B. 磷酸锌水门汀
C. 玻璃离子水门汀
D. 牙胶
E. 护洞漆

正确答案：C。玻璃离子水门汀

解析：本题考查垫底。玻璃离子水门汀强度较高，且对牙髓刺激性小，因含氟具有防龋作用，常作为复合树脂充填时的基底料（C对）。氧化锌丁香油水门汀，影响树脂聚合，不能作为树脂充填时的基底料（A错）。磷酸锌水门汀，呈酸性对牙髓有刺激，不能直接垫底（B错）。牙胶是常用的根管充填材料（D错）。护洞漆可影响树脂聚合，树脂中的游离单体可溶解护洞漆，复合树脂充填时不能用护洞漆处理窝洞（E错）。